延髓前正中裂两旁的隆起是
A. 薄束结节
B. 楔束结节
C. 锥体
D. 大脑脚
E. 以上都不对

正确答案：C。锥体

解析：锥体（C对）为延髓腹侧面前正中裂两旁的纵行隆起，由大脑皮质发出的下行锥体束（主要为皮质脊髓束）纤维构成。延髓背侧面正中有后正中沟，两侧各有两个膨大,内侧者为薄束结节（A错），外上者为楔束结节（B错），二者分别与脊髓的薄束、楔束相延续。中脑两侧各有一粗大的纵行柱状隆起，称大脑脚（D错），其浅部主要由大脑皮质发出的下行纤维构成。